某年轻女患者，因患左侧乳腺癌住院行根治术。术中同时为右侧乳房一个不明显硬结也作了常规的冷冻病理切片，结果提示：右侧乳房小肿块部分癌变。此时，医生的最佳伦理选择是
A. 依人道原则，立即行右乳大部分切除术
B. 依救死扶伤原则，立即行右乳大部分切除术
C. 依有利原则，立即行右乳根治术
D. 依知情同意原则，立即行右乳根治术
E. 依知情同意原则，立即行右乳大部分切除术

正确答案：E。依知情同意原则，立即行右乳大部分切除术